女，38岁。低热2个月，左大腿根部肿物10天。查体：左腹股沟处可触及5cm×5cm质软圆形肿物，轻度压痛。B超显示为低回声肿物。腰椎X线片上见腰大肌阴影增宽，L₂、L₃椎体边缘骨质破坏，L₂～L₃椎间隙狭窄。首先应考虑的诊断是
A. 转移性骨肿瘤
B. 类风湿性关节炎
C. 骨髓炎
D. 骨结核
E. 骨巨细胞瘤

正确答案：D。骨结核

解析：青年女性患者，低热2个月（提示可能为结核中毒症状），左大腿根部肿物，查体左腹股沟处可触及5cm×5cm质软圆形肿物，轻度压痛，B超显示为低回声肿物（提示内容物为液体），腰椎X线片上见腰大肌阴影增宽，提示可能为腰椎流注脓肿，并已沿腰大肌流注至股骨小转子处，成为腹股沟处深部脓肿。L2、L3椎体边缘骨质破坏，L2-L3椎间隙狭窄（提示结核侵犯椎体部位），结合患者症状、体征和影像学检查，首先应考虑的诊断是骨结核（D对）。转移性骨肿瘤（A错）可有脊柱骨质破坏，椎间隙狭窄，但以椎弓根受累较常见，不会出现腰大肌阴影增宽及寒性脓肿。类风湿性关节炎（B错）多见于女性，多累及近端小关节，呈对称性改变。骨髓炎（P738）（C错）多发生于胫骨上端和股骨下端，主要表现为恶寒、高热、呕吐等全身症状，局部脓肿分层穿刺可确诊。骨巨细胞瘤（P776）（E错）常累及长骨干骺端及椎体，但Ｘ线表现为骨端偏心位、溶骨性、囊性破坏而无骨膜反应。